尊重患者自主性或决定，在病人坚持已见时，可能要求医生
A. 放弃自己的责任
B. 听命于患者
C. 无须具体分析
D. 必要时限制病人自主性
E. 不伤害患者

正确答案：D。必要时限制病人自主性